天疱疮发病机制的核心在于
A. 变态反应
B. 棘层松解
C. 异常增生
D. 感染因素
E. 创伤因素

正确答案：B。棘层松解

解析：本题考查天疱疮发病机制。天疱疮发病机制的核心在于棘层松解（B对）。天疱疮是一种自身免疫性疾病（A错），其发病机制为患者的黏膜上皮棘细胞间存在抗粘接成分的抗原抗体反应，从而导致棘层松解和水疱形成。异常增生（C错）、感染因素（D错）、创伤因素（E错）均不是天疱疮的发病机制。